在五输穴中,合穴主要治疗
A. 心下满
B. 身热
C. 体重节痛
D. 喘咳寒热
E. 逆气而泄

正确答案：E。逆气而泄

解析：该题考查原文。五输穴中，井主心下满（A错）荥主身热（B错）。输主体重节痛（C错）经主喘咳寒热（D错）合主逆气而泄（E对）。